需同服维生素B₆的抗结核病药是
A. 利福平
B. 乙胺丁醇
C. 异烟肼
D. 对氨基水杨酸
E. 乙硫异烟胺

正确答案：C。异烟肼

解析：本题考查药物的联合应用。需同服维生素B₆的抗结核病药是异烟肼（C对）。异烟肼为维生素B₆的拮抗剂，可增加维生素B₆经肾排出量，易致周围神经炎的发生。同时服用维生素B₆者，需酌情增加用量。